64岁男性患者，反复咳嗽、咯痰，痰中带血2周。体温38.3℃，WBC12×10⁹/L，胸片右肺门肿块影，伴远端大片状阴影，抗炎治疗阴影不吸收。首先考虑的治疗方案是
A. 抗炎治疗
B. 抗炎止血治疗
C. 手术治疗
D. 抗结核治疗
E. 门诊随访

正确答案：C。手术治疗

解析：老年男性患者，咳嗽咯痰、痰中带血，虽有体温升高、白细胞增高（正常值4～10×10⁹/L），但抗炎治疗病变阴影不吸收（提示非肺部感染，考虑可能为肺癌所致），胸片示肿块影位于右肺门，结合患者病史、临床表现和影像学检查，该患者最可能的诊断为右侧中心型肺癌。患者尚无淋巴结转移征象，提示为早期肺癌，故首先考虑的治疗方案是手术治疗（C对）。肺癌不是感染性疾病，抗炎（AB错）、抗结核（D错）治疗无效。该患者已出现咯血等明显的临床症状，仅门诊随访（E错）显然不妥。